下列对白血病的描述，错误的是
A. 在我国，急性白血病比慢性白血病多见
B. 成人患者中，急性粒细胞白血病多见
C. 白细胞计数多数低于正常范围
D. 急性白血病约半数以上以发热起病
E. 中枢神经系统白血病多见于儿童

正确答案：C。白细胞计数多数低于正常范围

解析：大多数白血病患者白细胞增多，＞10×109/L者称为白细胞增多性白血病，只有少数患者白细胞计数正常或减少（C错，为本题正确答案）。在我国，急性白血病比慢性白血病多见（约5.5:1）（A对）；成人患者中，急性粒细胞白血病多见（1.62/10万）（B对）；半数患者以发热为早期表现（D对）；中枢神经系统白血病以急性淋巴细胞白血病最常见，儿童尤甚（E对）。